以上疾病中可以出现高热，角弓反张，伴发苦笑面容的是
A. 破伤风
B. 肺结核
C. 气性坏疽
D. 脑出血
E. 胸腔积液

正确答案：A。破伤风

解析：破伤风临床表现中，最早出现的是咀嚼肌肉痉挛导致张口受限，苦笑面容，颈项强直，角弓反张等症状。掌握“特殊性感染”知识点。